既可发生于上颌，又可发生于下颌的发育异常为
A. 腭裂
B. 颌裂
C. 悬雍垂裂
D. 斜面裂
E. 侧鼻裂

正确答案：B。颌裂

解析：颌裂属于腭的发育异常的一种，可发生于上颌，也可发生于下颌，但上颌裂较常见。掌握“腭部与舌的发育”知识点。